男，40岁，体温39℃，心率96次/分，轻微咳嗽，肌肉酸痛，X片示：下肺有斑片状融合影。高热，肌痛，双肺融合影。最可能的致病菌是
A. 金葡菌
B. 军团菌
C. 衣原体
D. 肺炎链球菌
E. 病毒性肺炎

正确答案：B。军团菌

解析：军团菌症状：高热、肌痛和相对缓脉。X线征象：下叶斑片浸润，进展迅速，无空洞（B对）。金黄色葡萄球菌症状：起病急，伴有寒战、高热、脓血痰、气急、毒血症症状和休克。X线征象：肺叶或小叶浸润，早期空洞，脓胸，可见液气囊腔（A错）。（P44）衣原体症状：起病缓，可小流行，伴有乏力、肌痛、头痛。X线征象：下叶间质性支气管肺炎，3～4周可自行消散（C错）。肺炎链球菌：起病急，寒战、高热、咳铁锈色痰，胸痛，肺实变体征。X线征象：肺叶或肺段实变，无空洞，可伴胸腔积液（D错）。病毒性肺炎：好发于病毒性疾病流行季节，症状通常较轻，与支原体肺炎的症状相似，但起病较急，发热、头痛、全身酸痛、倦怠等全身症状较突出，常在急性流感症状尚未消退时即出现咳嗽，少痰或白色黏痰、咽痛等呼吸道症状（E错）。